有关右心房的描述何者错误
A. 借上腔静脉收纳上半身的静脉血
B. 借下腔静脉收纳下半身的静脉血
C. 借肺静脉收纳肺的静脉血
D. 借右房室口将血液导入右心室
E. 借冠状窦口收纳心的静脉血

正确答案：C。借肺静脉收纳肺的静脉血

解析：右心房借上腔静脉收纳上半身的静脉血（A对）、借下腔静脉收纳下半身的静脉血（B对）、借右房室口将血液导入右心室（D对）、借冠状窦口收纳心的静脉血（E对）。借肺静脉收纳肺的静脉血（C错，为本题正确答案）为左心房。